随机抽查某年某市市区1000名男孩出生体重（kg），得均数等于3.3kg，标准差等于0.5kg，则估计这1000名男孩中出生体重不超过3.3kg-1.64×0.5kg的人数约为
A. 50
B. 100
C. 200
D. 250
E. 300

正确答案：A。50

解析：本题考查正态分布的相关内容。根据X-1.64S左侧面积5％，计算1000名男孩中出生体重不超过3.3kg-1.64×0.5kg的人数为1000×5％=50人（A对BCDE错）。